蝉蜕配胖大海除清宣肺气外，又能
A. 凉血止血
B. 止咳平喘
C. 通鼻窍
D. 清利头目
E. 利咽开音

正确答案：E。利咽开音

解析：本题考查的是蝉蜕的配伍。蝉蜕配胖大海除清宣肺气外，又能利咽开音（E对）。蝉蜕：【配伍】蝉蜕配胖大海：蝉蜕甘寒质轻，功能疏散风热、宣肺疗哑；胖大海甘寒，功能清宣肺气、利咽开音。两药相配，清宣肺气、利咽开音力强，善治风热或肺热之咽痛音哑。桑叶：【功效】疏散风热，清肺润燥，平肝明目，凉血止血（A错）。桃仁：【功效】活血祛瘀，润肠通便，止咳平喘（B错）。苍耳子：【功效】散风寒，通鼻窍（C错），除湿止痛，止痒。薄荷：【功效】宣散风热，清利头目（D错），利咽，透疹，疏肝。